一存活多年的同种异体肾移植接受者的体内虽有供体HLA人抗原表达，却未发生明显的排斥反应，其原因可能是
A. 受者的免疫细胞功能活跃
B. 移植物的免疫细胞功能活跃
C. 移植物已失去了免疫原性
D. 受者对移植物发生了免疫耐受
E. 移植物对受者发生了免疫耐受

正确答案：D。受者对移植物发生了免疫耐受

解析：当受者对移植物发生了免疫耐受（D对）时，移植接受者的体内虽有供体人抗原表达，但不会发生明显的排斥反应。移植物抗宿主反应常见于骨髓，胸腺、脾脏等抗原特异性淋巴细胞含量丰富的器官移植中，肾脏一般不会出现。肾脏中一般不会含有抗原特异性淋巴细胞，故而不会出现移植物对受者发生了免疫耐受（E错）。无论是受者的免疫细胞功能活跃（A错），还是移植物的免疫细胞功能活跃（B错）两者都会出现明显的排斥反应。器官移植中，器官作为移植物始终保有免疫原性（C错）。